来源于多孔菌科的药材是
A. 茯苓
B. 冬虫夏草
C. 海藻
D. 松萝
E. 五倍子

正确答案：A。茯苓

解析：本题考查的是茯苓的来源。来源于多孔菌科的药材是茯苓（A对）。茯苓：【来源】为多孔菌科真菌茯苓的干燥菌核。冬虫夏草（B错）：【来源】为麦角菌科真菌冬虫夏草寄生在蝙蝠蛾科昆虫幼虫上的子座及幼虫尸体的干燥复合体。海藻（C错）：【来源】为马尾藻科植物海蒿子或羊栖菜的干燥藻体。松萝（D错）为地衣类中药。五倍子（E错）：【来源】为漆树科植物盐肤木、青麸杨或红麸杨叶上的虫瘿，主要由五倍子蚜寄生而形成。按外形不同，分为“肚倍”和“角倍”。五倍子的产生，必须兼有寄主盐肤木类植物、五倍子蚜虫和过冬寄主提灯藓类植物等三要素，而且此种苔藓类植物需终年湿润，以利蚜虫过冬。